左侧角回损伤将导致
A. 能够发音，但不能说出有意义的语言
B. 手能够运动，但不能写字
C. 双耳听觉正常，但不能听懂语言
D. 双眼视觉正常，但不能认识和理解文字
E. 以上都不是

正确答案：D。双眼视觉正常，但不能认识和理解文字

解析：左侧角回为视觉性语言区即阅读中枢所在位置，此中枢与文字的理解和认图密切相关，损伤将导致双眼视觉正常，但不能认识和理解文字（D对），称为失读症。能够发音，但不能说出有意义的语言（A错）为位于额下回后部的运动性语言区损伤的表现，称为运动性失语症。手能够运动，但不能写字（B错）为位于额中回后部的书写区损伤的表现，称为失写症。双耳听觉正常，但不能听懂语言（C错）为位于颞上回后部的听觉性语言区损伤的表现，称为感觉性失语症。